反映苯接触水平的指标是
A. 测血中的赫恩小体
B. 测血中高铁血红蛋白的含量
C. 测尿酚的量
D. 测尿中对苯二酚的含量
E. 测尿中对苯硫醇的含量

正确答案：C。测尿酚的量